确定《基本医疗保险药品目录》中“甲类目录”的原则是
A. 标签和说明书符合规定，用语科学易懂的药品
B. 临床治疗必须，使用方便，符合质量要求的药品
C. 临床治疗必需，使用广泛，疗效好，同类药品中价格低的药品
D. 可供临床治疗选择使用，疗效好，同类药品中价格略高的药品
E. 市场价格最低的药品

正确答案：C。临床治疗必需，使用广泛，疗效好，同类药品中价格低的药品

解析：本题考查药品目录。《城镇职工基本医疗保险用药范围管理暂行办法》第六条规定，《药品目录》中的西药和中成药在《国家基本药物》的基础上遴选，并分“甲类目录”和“乙类目录”“甲类目录”的药品是临床治疗必需，使用广泛，疗效好，同类药品中价格低的药品（C对）。“乙类目录”的药品是可供临床治疗选择使用，疗效好，同类药品中比“甲类目录”药品价格略高的药品（D错）。各省（区、市）社会保险主管部门对《药品目录》甲类药品不得进行调整，并应严格按照现行法律法规和文件规定进行乙类药品调整。